review指的是
A. 系统回顾
B. 传统综述
C. 系统综述
D. 叙述性综述
E. 循证医学

正确答案：C。系统综述

解析：本题考查系统综述。Systematic review指的是系统综述（C对ABDE错），它是应用一定的标准化方法，针对某一特定问题的相关研究报告进行全面、系统的收集，并对它们鉴定、选择和严格评价，从符合纳入标准的研究报告中提取相关资料，做整合性分析，最终得出综合性的结论。